C4b可结合细菌使其更容易被表达补体受体的吞噬细胞吞噬的作用
A. 免疫黏附
B. 炎症介导
C. 调理吞噬
D. 经典途径
E. 膜攻击复合物的生物学作用

正确答案：C。调理吞噬

解析：调理吞噬：C3b/C4b可结合细菌或真菌使其更容易被表达补体受体的吞噬细胞吞噬。掌握“补体功能及其与疾病的关系”知识点。